在为社区居民进行刷牙指导时，口腔医师指出应使用保健牙刷，并告诉人们
A. 磨圆的刷毛端比平切刷毛端对牙龈损伤更小
B. 尼龙丝刷毛遇高温不易卷曲
C. 天然鬃毛容易干燥、耐磨损
D. 刷牙后应将刷头向下放在口杯中
E. 空气干燥法是清除牙刷细菌最完善的方法

正确答案：A。磨圆的刷毛端比平切刷毛端对牙龈损伤更小

解析：牙刷的刷毛不能使用自然的鬃毛，刷牙应该用流水反复冲洗刷头，并将刷头的水分充分甩干，置于通风处充分干燥。而且对于牙刷刷毛端的处理过的圆头端比平切端对牙周的损害更小。掌握“自我口腔保健方法”知识点。